下列各项，对判断霍乱患者脱水程度最有意义的是
A. 皮肤黏膜弹性
B. 血压
C. 血细胞比容
D. 血钠
E. 血浆比重

正确答案：E。血浆比重

解析：频繁的泻吐使患者迅速出现脱水、电解质紊乱及代谢性酸中毒，严重者可出现循环衰竭、急性肾衰端。脱水程度可根据血浆比重等判断（E对）。